某地区在1个月内对居民进行了是否有糖尿病的普查，可计算当地居民糖尿病的
A. 发病率
B. 罹患率
C. 死亡率
D. 患病率
E. 二代发病率

正确答案：D。患病率

解析：某地区在1个月内对居民进行了是否有糖尿病的普查，因此可统计出该地区该时间糖尿病患病例数以及该地同期平均人口数，因此可求得患病=该地区该时间糖尿病患病例数/该地同期平均人口数，可用来表示糖尿病的发生或流行情况。发病率（A错）表示一定期间内，一定人群中某病新发生的病例出现的频率，是反映疾病对人群健康影响和描述疾病分布状态的一项测量指标。罹患率（B错）与发病率一样，也是测量人群新病例发生频率的指标，仅适用于小范围、短时间内疾病频率的测量。死亡率（C错）又称粗死亡率，表示某年某地每千人口中的死亡人数，反映当地居民总的死亡水平。二代发病率（E错）指某传染病易感接触者中，在最短潜伏期与最长潜伏期之间发病的人数占所有易感接触者总数的百分率。